经茎乳孔出颅后的面神经所含纤维为
A. 副交感纤维
B. 感觉纤维
C. 运动纤维
D. 运动纤维与感觉纤维
E. 副交感纤维与感觉纤维

正确答案：C。运动纤维

解析：经茎乳孔出颅后的面神经所含纤维为运动纤维（C对），支配除了咀嚼肌、上睑提肌以外的面部诸表情肌及耳部肌、枕肌、颈阔肌及镫骨肌等。